下列哪项不是直接导致冲任损伤的因素
A. 邪毒感染
B. 郁怒悲伤
C. 房劳多产
D. 跌扑闪挫
E. 寒湿之邪

正确答案：B。郁怒悲伤

解析：感染邪毒，邪毒乘虚而入，损伤冲任（A对）。郁怒悲伤多先导致肝失疏泄，脾失健运，进而导致冲任不调，不是直接导致冲任损伤（B错，为本题正确答案）。房劳多产，耗伤气血致冲任损伤（C对）。跌仆闪挫可直接损伤胞脉、胞络致冲任损伤（D对）。寒湿之邪由外及里，伤及肌表、经络、血脉或经期，产后血室正开，寒邪由阴户上客，入侵冲任、子宫进而产生妇科病（E对）。